世界上最早的关于人体试验的国际性医德文献是
A. 1803年的《医学伦理学》
B. 1947年的《纽伦堡法典》
C. 1948年的《日内瓦宣言》
D. 1964年的《赫尔辛基宣言》
E. 1981年的《人体生物医学研究的国际标准》

正确答案：B。1947年的《纽伦堡法典》

解析：伦理委员会对涉及人的生物医学研究和相关技术应用项目的伦理审查要求依据国内外颁布的有关文件规定和要求。其中最早的国际文件有1947年纽伦堡国际军事法庭制定的《纽伦堡法典》。掌握“涉及人和动物的医学实验伦理”知识点。